男，45岁，左下肢疼痛发凉半年。既往有左下肢血栓性浅静脉炎病史，无高血压、糖尿病病史。吸烟20年，20支/天。查体：右下肢正常；左足苍白，皮温明显降低，左足背动脉搏动消失，左股、腘动脉可触及搏动。Buerger试验阳性。最有可能的诊断是左下肢
A. 急性动脉栓塞
B. 血栓闭塞性脉管炎
C. 原发性下肢静脉曲张
D. 动脉硬化性闭塞症
E. 深静脉血栓形成

正确答案：B。血栓闭塞性脉管炎

解析：45岁男性患者（血栓闭塞性脉管炎好发人群），左下肢疼痛发凉半年（起病隐匿，发展缓慢），既往有左下肢血栓性浅静脉炎病史，无高血压、糖尿病病史（无动脉硬化因素），吸烟20年，20支/天（吸烟为血栓闭塞性脉管炎发生发展的重要因素），查体：右下肢正常；左足苍白，皮温明显降低，左足背动脉搏动消失（血栓闭塞性脉管炎典型表现），左股、胭动脉可触及搏动，Buerger试验阳性（提示患肢有严重供血不足），根据患者的病史、临床症状、体征和病理征，最有可能的诊断是血栓闭塞性脉管炎（B对），血栓闭塞性脉管炎（TAO），又称Buerger病，是血管的炎性、节段性和反复发作的慢性闭塞性疾病。急性动脉栓塞（P490）（A错）是动脉腔被进入血管内的栓子堵塞，导致血流阻塞，引起急性缺血的临床表现，特点是起病急骤，缺血症状明显，进展迅速，后果严重，有典型的5“P”征（疼痛、感觉异常、麻痹、无脉、苍白）。原发性下肢静脉曲张（P500）（C错）主要临床表现下肢浅静脉扩张、迂曲，下肢有沉重、乏力感，踝部可有轻度肿胀和足靴区皮肤营养性变化（皮肤色素沉着、皮炎、湿疹、皮下脂质硬化和溃疡形成）。动脉硬化性闭塞症（P487）（D错）发生在大、中动脉，涉及腹主动脉及其远侧主干动脉时，引起下肢慢性缺血，高脂血症、高血压、吸烟、糖尿病、肥胖等是高危因素，患肢的股、腘、胫后及足背动脉搏动减弱或不能扪及。深静脉血栓形成（P502）（E错）多为突然发生患肢肿胀，伴有胀痛、浅静脉扩张，局限在小腿部的深静脉血栓主要表现为突然出现小腿剧痛，幻足不能着地踏平，行走时症状加重，小腿肿胀且有深压痛，Homans征阳性。